能够反映长期膳食行为、可用于研究慢性病与膳食模式关系的膳食调查方法是
A. 称重法
B. 记帐法
C. 膳食回顾法
D. 化学分析法
E. 食物频数法

正确答案：E。食物频数法

解析：本题考查食物频数法。食物频数法（E对ABCD错）是收集被调查对象过去一段时间（数周、数月或数年）内各种食物消费频率及消费量，从而获得个人长期食物和营养素平均摄入量。该法可快速得到平时各种食物摄入的种类和数量，反映长期膳食行为，其结果可作为研究慢性病与膳食模式关系的依据，也可供膳食咨询指导之用。